下列脊椎病变除哪项外，脊椎叩痛常为阳性
A. 脊椎结核
B. 棘间韧带损伤
C. 骨折
D. 骨质增生
E. 椎间盘脱出

正确答案：D。骨质增生

解析：正常人脊柱无叩击痛，脊椎结核（A对）、棘间韧带损伤（B对）、骨折（C对）、椎间盘脱出（E对）均可有脊椎叩痛的表现。骨质增生（D错，为本题正确答案）多见于腰椎和颈椎，临床表现为疼痛、活动受限，多无明确压痛点，一般不会出现脊椎叩痛阳性和神经压迫体征。